尺神经损伤最容易出现的畸形是
A. 枪刺样畸形
B. 爪形手畸形
C. 垂腕畸形
D. 银叉样畸形
E. 天鹅颈样畸形

正确答案：B。爪形手畸形

解析：尺神经损伤最容易出现的畸形是爪型手畸形（B对）。枪刺样畸形（A错）为桡骨远端骨折的正面观。垂腕畸形（C错）为桡神经损伤最容易出现的畸形。银叉样畸形（D错）为桡骨远端骨折的侧面观。天鹅颈样畸形（E错）指掌指关节屈曲，近端指间关节过伸，远端指间关节屈曲，从侧面看来很像天鹅的颈部，是手部关节畸形的一种，可见于类风湿关节炎。